内痔的主要症状是
A. 便血，疼痛
B. 便血，有分泌物
C. 便血，脱出
D. 便血，肛门痒
E. 便血，异物感

正确答案：C。便血，脱出

解析：内痔，是指肛门齿状线以上，直肠末端黏膜以下的痔内静脉丛扩大曲张和充血所形成的柔软静脉团，临床表现有便血，脱出，肛周潮湿、瘙痒，疼痛和便秘，其中便血、脱出为内痔的主要症状（C对）。疼痛为次要症状（A错）。有分泌物为次要症状（B错）。肛门痒为次要症状（D错）。异物感为外痔的临床特点（E错）。